某男，59岁。腰痛日久，酸软无力，缠绵不愈，局部发凉，喜温喜按，遇劳更甚，卧则减轻，少腹拘急，面色白，头晕耳鸣，肢冷畏寒；舌淡，脉沉细无力。宜选用的基础方剂是
A. 左归丸
B. 右归丸
C. 四妙丸
D. 四逆散
E. 乌头汤

正确答案：B。右归丸

解析：本题考查的是肾虚腰痛的方剂应用。某男，59岁。腰痛日久，酸软无力，缠绵不愈，局部发凉，喜温喜按，遇劳更甚，卧则减轻，少腹拘急，面色白，头晕耳鸣，肢冷畏寒；舌淡，脉沉细无力。宜选用的基础方剂是右归丸（B对）。肾虚腰痛【症状】腰部隐隐作痛，酸软无力，劳则加重，卧则减轻，或伴有耳鸣耳聋。偏于肾阴虚者，兼有手足心热，潮热盗汗，口燥咽干，舌红少苔，脉细数；偏于肾阳虚者，兼有腰部冷痛，得热则舒，肢冷畏寒，面色㿠白，舌淡胖有齿痕，脉沉细无力。【方剂应用】基础方剂偏于肾阴虚者，以左归丸（A错）（熟地黄、山药、枸杞子、山茱萸、川牛膝、菟丝子、鹿角胶、龟板胶）加减。偏于肾阳虚者，以右归丸（熟地黄、山药、山茱萸、枸杞子、菟丝子、鹿角胶、杜仲、肉桂、当归、制附子）加减。湿热腰痛【症状】腰部疼痛，重着而热，暑湿阴雨天气症状加重，活动后或可减轻，身体困重，小便短赤。舌质红，苔黄腻，脉濡数或弦数。【方剂应用】基础方剂四妙丸（C错）（黄柏、苍术、牛膝、薏苡仁）加减。胁痛肝郁气滞证【症状】胁肋胀痛，走窜不定，甚则引及项背肩臂，疼痛每因情志变化而增减，胸闷腹胀，嗳气频作，得嗳气而胀痛稍舒，纳少口苦。舌苔薄白，脉弦。【中成药应用】合理用药与用药指导肝郁气滞伴食滞不消者宜选柴胡舒肝丸；肝郁气滞伴厥逆者宜选四逆散（D错）；肝郁气滞伴有胃部不适者宜选舒肝止痛丸。痹证痛痹【症状】肢体关节疼痛，痛势较剧，部位固定，遇寒则痛甚，得热则痛缓，关节屈伸不利，局部皮肤或有寒冷感。舌质淡，舌苔薄白，脉弦紧。【方剂应用】基础方剂乌头汤（E错）（川乌、芍药、麻黄、黄芪、甘草）加减。